女，25岁。发现心悸、盗汗、易怒1年，伴有饮食量增加及消瘦。查体：BP110/80mmHg，重度突眼，甲状腺弥漫性肿大，深入胸骨后上纵隔内，心率116次/分。测血T₃、T₄值高于参考值上限一倍。该患者诊断是
A. Graves病
B. 高功能腺瘤
C. 结节性甲状腺肿
D. 亚急性甲状腺炎
E. 慢性淋巴细胞性甲状腺炎

正确答案：A。Graves病

解析：青年女性患者，心悸、盗汗、易怒、多食、消瘦（甲亢的高代谢症候群）。体查：心率116次/分（脉率明显增快），重度突眼（Graves眼病的临床表现），甲状腺弥漫性肿大。实验室检查：血T₃、T₄值高于参考值上限一倍（提示甲状腺毒症）。综合病史、体查、实验室检查，该患者诊断是Graves病（A对），即弥漫性毒性甲状腺肿。高功能腺瘤（P228）（B错）有甲亢高代谢症候群，但无甲状腺弥漫性肿大。结节性甲状腺肿（C错）为甲状腺多结节性肿大，而不是弥漫性肿大，无突眼及甲亢高代谢症候群。亚急性甲状腺炎（P230）（D错）大多在发病前1～2周有上呼吸道感染史，多表现为甲状腺突然肿胀、发硬，可有压痛及吞咽困难。慢性淋巴细胞性甲状腺炎（P231）（E错）可有无痛性弥漫性甲状腺肿，但多伴有甲状腺功能减退症状而非甲亢症状。